纤溶酶的主要作用是
A. 激活因子Ⅻ
B. 激活补体系统
C. 抑制激肽系统
D. 水解凝血酶因子Ⅶ、V
E. 水解纤维蛋白原和纤维蛋白

正确答案：E。水解纤维蛋白原和纤维蛋白